PVA是常用的成膜材料，PVA05～88是指
A. 相对分子质量是500～600
B. 相对分子质量是8800、醇解度是50%
C. 平均聚合度是500～600、醇解度是88%
D. 平均聚合度是86～90、醇解度是50%
E. 以上均不正确

正确答案：D。平均聚合度是86～90、醇解度是50%